牙种植手术的禁忌证包括
A. 颌骨肿瘤
B. 严重习惯性磨牙症
C. 精神病患者
D. 严重糖尿病
E. 以上都是

正确答案：E。以上都是

解析：禁忌证①全身情况差或严重系统疾病不能承受手术者。②严重糖尿病，血糖过高或已有明显并发症者，因术后易造成感染，故应在糖尿病得到控制时方可手术。③口腔内有急、慢性炎症者，如牙龈、黏膜、上颌窦炎症等，应在治愈后手术。④口腔或颌骨内有良、恶性肿瘤者。⑤某些骨疾病，如骨质疏松症、骨软化症及骨硬化症等。⑥严重习惯性磨牙症。⑦口腔卫生不良者。⑧精神病患者。掌握“牙种植手术及效果评估”知识点。